最不易发生牙周破坏的牙位是
A. 上颌切牙和下颌磨牙
B. 下颌切牙和上颌磨牙
C. 上颌尖牙和下颌前磨牙
D. 下颌尖牙和上颌前磨牙
E. 上颌和下颌前磨牙

正确答案：C。上颌尖牙和下颌前磨牙

解析：本题考查最不易发生牙周破坏的牙位。临床上，下颌前牙和磨牙区易发生牙周炎，上颌前牙和下颌前磨牙区（C对）不易发生牙周破坏。下颌前牙（BD错）和上颌磨牙区（E错）有唾液腺导管开口，菌斑牙石易于堆积，易导致牙周破坏。磨牙区（A错）清洁不彻底易积存食物，导致菌斑牙石堆积，导致牙周破坏。